苏合香丸中所含的有毒药是
A. 蟾酥
B. 朱砂
C. 附子
D. 雄黄
E. 马钱子

正确答案：B。朱砂

解析：本题考查的是含朱砂、轻粉、红粉的中成药。苏合香丸中所含的有毒药是朱砂（B对）。含朱砂、轻粉、红粉的中成药：牛黄清心丸、牛黄抱龙丸、抱龙丸、朱砂安神丸、天王补心丸、安神补脑丸、苏合香丸、人参再造丸、安宫牛黄丸、牛黄千金散、牛黄镇惊丸、紫雪散、梅花点舌丸、紫金锭（散）、磁朱丸、更衣丸、复方芦荟胶囊。含蟾酥（A错）的中成药：六神丸、六应丸、喉症丸、梅花点舌丸、麝香保心丸、麝香通心滴丸等。含乌头类药物（C错）的中成药：追风丸、追风透骨丸、三七伤药片、附子理中丸、金匮肾气丸、木瓜丸、小金丸、风湿骨痛胶囊、祛风止痛片、祛风舒筋丸、正天丸、右归丸等。含雄黄（D错）的中成药：牛黄解毒丸（片）、六神丸、喉症丸、安宫牛黄丸、牛黄清心丸、牛黄镇惊丸、牛黄抱龙丸、牛黄至宝丸、追风丸、牛黄醒消丸、紫金锭（散）、三品等。含马钱子（E错）的中成药：九分散、山药丸、舒筋丸、疏风定痛丸、伤科七味片等。